男，40岁。无痛性双侧颈部淋巴结进行性肿大伴发热半月，发病以来体温最高37.5℃，无盗汗，体重无明显变化。查体：双侧颈部各触及一个2cm×2cm大小淋巴结，左腋窝一个2cm×1cm淋巴结，活动，无压痛，腹软，肝脾肋下未触及。化验：Hb126g/L，WBC5.3×10⁹/L，PLT155×10⁹/L，胸腹部CT未见明显淋巴结肿大。右颈部淋巴结活检为弥漫性大B细胞淋巴瘤。本例最可能的分期是
A. Ⅰ期
B. ⅡA期
C. ⅡB期
D. Ⅲ期
E. Ⅳ期

正确答案：B。ⅡA期

解析：患者中年男性，无痛性双侧颈部淋巴结进行性肿大伴发热半月，颈部淋巴结活检已证实为弥漫性大B细胞淋巴瘤，发病以来体温最高37.5℃，无盗汗，体重无明显变化（1.不明原因发热大于38℃；2.盗汗；3.半年内体重下降10%以上出现一项即可分为B组）提示全身症状分组为A组；查体双侧颈部、左腋窝淋巴结肿大，肝脾肋下未触及，胸腹部CT未见明显淋巴结肿大（Ann Arbor分期系统不仅适用于霍奇金淋巴瘤，还适用于非霍奇金淋巴瘤。Ⅱ期：在膈肌同侧的两组或多组淋巴结受侵犯（Ⅱ）或局灶性单个结外器官及其区域淋巴结受侵犯，伴或不伴横膈同侧其他淋巴结区域受侵犯（ⅡE））提示患者为Ⅱ期，综合分析患者最可能的临床分期为ⅡA期（B对）。